与宫颈癌的发生有关的是
A. 人乳头瘤状病毒
B. 脑炎病毒
C. 巨细胞病毒
D. 狂犬病病毒
E. 柯萨奇病毒

正确答案：A。人乳头瘤状病毒

解析：与宫颈癌的发生有关的是人乳头瘤状病毒（A对），人乳头瘤病毒属于乳头瘤病毒科乳头瘤病毒属，主要引起人类皮肤黏膜的增生性病变，其中高危性HPV（16型、18型等）与子宫颈癌等恶性肿瘤的发生密切相关，低危性HPV（6型、11型等）引起生殖器尖锐湿疣。脑炎病毒（流行性乙型脑炎病毒）（B错），主要侵犯中枢神经系统，引起流行性乙型脑炎，表现为高热、头痛、意识障碍、抽搐和脑膜刺激征等，严重者可进一步发展为昏迷、中枢性呼吸衰竭或脑疝（P279）。巨细胞病毒（C错）在人群中的感染极为普遍，原发感染发生在2岁以下，通常为隐性感染，仅少数患者出现临床症状，在机体免疫功能低下时易发生显性感染，是引起先天性畸形最常见的病原（P299）。狂犬病病毒（D错）是一种嗜神经病毒，可引起狂犬病（恐水症），通过动物咬伤或密切接触等形式在动物间或动物人类间传播（P313）。柯萨奇病毒（E错）致病特点是在肠道增殖却很少引起肠道疾病，主要可导致无菌性脑膜炎、疱疹性咽峡炎、手足口病、流行性胸痛、心肌炎、急性结膜炎等（P253表26-2）。